通过抑制血管紧张素转化酶而发挥降压作用，起效快，适用于高血压急症的血管紧张素转化酶抑制剂类药物的是
A. 雷米普利
B. 卡托普利
C. 赖诺普利
D. 厄贝沙坦
E. 氯沙坦

正确答案：B。卡托普利

解析：本题考查卡托普利的作用特点及适应症。卡托普利（B对）起效快，作用时间较短，适用于高血压急症。